男，56岁。乏力，食欲不振、恶心、消瘦1个月。乙型肝炎病史10年。查体：皮肤巩膜无黄染，腹软，剑突下压痛，肝肋下3cm，可触及质硬的结节，Murphy征阴性，移动性浊音阳性。为明确肝脏结节性质，最有诊断价值的肿瘤标志物是
A. CEA
B. CA125
C. CK19
D. AFP
E. CA19-9

正确答案：D。AFP

解析：中老年患者，肝炎病史，消化道症状，肝大有质硬结节，考虑肝癌。AFP（甲胎蛋白）是一种糖蛋白，正常情况下由幼稚的肝细胞产生，肝癌细胞是尚未分化的肝细胞，能大量分泌AFP，AFP（D对）是对肝癌最有诊断价值的肿瘤标志物，对原发性肝癌诊断特异性最强、灵敏度最高的指标。CEA（癌胚抗原）（A错）是一种广谱性肿瘤标志物，可在多种肿瘤中表达，脏器特异性低。CA125（B错）主要用于卵巢癌的诊断，肝硬化失代偿期血清CA125也有升高，但对于肝癌诊断价值不大。CK19（C错）主要见于甲状腺乳头状瘤。CA199（E错）是胰腺癌首选肿瘤标志物。